玻璃离子水门汀作为充填材料的特点是
A. 牙色材料
B. 耐磨性好
C. 可释放氟
D. 操作时间有限
E. 与牙体组织有化学结合

正确答案：E。与牙体组织有化学结合

解析：本题考查玻璃离子水门汀。玻璃离子水门汀作为充填材料的特点是与牙体组织有化学结合（E对）。玻璃离子水门汀具有良好的粘结性，可与牙体组织发生化学结合，故有牢固的粘接力，是玻璃离子水门汀作为充填材料的特点。玻璃离子体的耐磨性较差，且弹性模量较低，脆性较大，抗张强度和抗压强度均小于复合树脂，美观性能也较复合树脂差（AB错）。可释放氟离子（C错）是玻璃离子水门汀的性能（与防龋有关）；操作时间都有限（D错）是玻璃离子水门汀充填的要求，均与题干不符。